卡比多巴和左旋多巴联合应用的原理
A. 抑制外周多巴脱羧酶
B. 促进多巴胺释放
C. 抑制多巴胺分解
D. 降解多巴胺
E. 降解多巴胺脱羧酶

正确答案：A。抑制外周多巴脱羧酶

解析：左旋多巴口服后极大部分在肠黏膜、肝和其他外周组织被L-芳香族氨基酸脱羧酶脱羧成为多巴胺，仅1%左右的左旋多巴能进入中枢神经系统发挥疗效。且外周的多巴胺易引起不良反应。若同时合用卡比多巴，可使左旋多巴在外周的脱羧作用被抑制（A对），减少外周多巴胺生成，使左旋多巴更多地进入脑内，增加血和脑内左旋多巴的量。